出生后第二个十年开始发育的系统是
A. 淋巴系统
B. 神经系统
C. 生殖系统
D. 内分泌系统
E. 呼吸系统

正确答案：C。生殖系统